种子水煮至种皮破裂时露出白色卷旋状胚的药材是
A. 葶苈子
B. 决明子
C. 牛蒡子
D. 牵牛子
E. 菟丝子

正确答案：E。菟丝子

解析：本题考查的是菟丝子的性状鉴别。种子水煮至种皮破裂时露出白色卷旋状胚的药材是菟丝子（E对）。菟丝子【性状鉴别】药材呈类球形，直径1～2mm。表面灰棕色或黄棕色，粗糙，种脐线形或扁圆形。质坚实，不易以指甲压碎。气微，味淡。取本品少量，加沸水浸泡后，表面有黏性；加热煮至种皮破裂时，可露出黄白色卷旋状的胚，形如吐丝。葶苈子（A错）【性状鉴别】药材南葶苈子：呈长圆形略扁，长0.8～1.2mm，宽约0.5mm。表面棕色或红棕色，微有光泽，具纵沟2条，其中1条较明显。一端钝圆，另端微凹或较平截，种脐类白色，位于凹入端或平截处。气微，味微辛、苦，略带黏性。北葶苈子：呈扁卵形，长1～1.5mm，宽0.5～1mm。一端钝圆，另一端渐尖而微凹，种脐位于凹入端。味微辛辣，黏性较强。本品加水浸泡后，用放大镜观察，南葶苈子透明状黏液层薄，厚度约为种子宽度的1/5以下。北葶苈子透明状黏液层较厚，厚度可超过种子宽度的1/2以上。决明子（B错）【性状鉴别】药材决明：略呈菱状方形或短圆柱形，两端平行倾斜，长3～7mm，宽2～4mm。表面绿棕色或暗棕色，平滑有光泽。一端较平坦、另端斜尖，背腹面各有1条突起的棱线，棱线两侧各有1条斜向对称而色较浅的线形凹纹。质坚硬，不易破碎。种皮薄，子叶2，黄色，呈“S”形折曲并重叠。气微，味微苦。牛蒡子（C错）【性状鉴别】药材呈长倒卵形，略扁，微弯曲，长5～7mm，宽2～3mm。表面灰褐色，带紫黑色斑点，有数条纵棱，通常中间1～2条较明显。顶端钝圆，稍宽，顶面有圆环，中间具点状花柱残迹；基部略窄，着生面色较淡。果皮较硬，子叶2，淡黄白色，富油性。气微，味苦后微辛而稍麻舌。牵牛子（D错）【性状鉴别】药材似橘瓣状，长4～8mm，宽3～5mm。表面灰黑色或淡黄白色，背面有1条浅纵沟，腹面棱线的下端有一点状种脐，微凹。质硬，横切面可见淡黄色或黄绿色皱缩折叠的子叶，微显油性。气微，味辛、苦，有麻感。加水浸泡后种皮呈龟裂状，手捻有明显的黏滑感。